下列可用糖皮质激素进行治疗的疾病是
A. 角膜溃疡
B. 真菌感染
C. 抗菌药不能控制的感染
D. 中毒性感染或同时伴有休克
E. 二重感染

正确答案：D。中毒性感染或同时伴有休克

解析：大剂量糖皮质激素具有抗炎、抗内毒素、抗休克作用，可短期应用于中毒性感染或同时伴有休克者（D对），如中毒性痢疾、中毒性肺炎、严重伤寒、流行性脑脊髓膜炎、结核性脑膜炎及败血症等，可迅速缓解症状，但必须同时合用有效而足量的抗菌药物，以免感染扩散。糖皮质激素无抗菌抗病毒作用，禁用于角膜溃疡（A错）、抗菌药物不能控制的真菌（B错）、病毒（C错）、等感染、活动性结核病、胃或十二指肠溃疡、严重高血压、动脉粥样硬化、糖尿病、骨质疏松、二重感染（E错）、孕妇、精神病等。